原发性高血压细动脉的可逆性改变是
A. 内膜下蛋白性物质沉积
B. 血管腔狭窄
C. 血管痉挛
D. 血管壁平滑肌萎缩
E. 血管纤维化

正确答案：C。血管痉挛

解析：原发性高血压功能紊乱期表现为全身细小动脉间歇性痉挛收缩、血压升高，因动脉无器质性病变，痉挛缓解后血压可恢复正常。血管痉挛（C对）为原发性高血压细动脉的可逆性改变。内膜下蛋白性物质沉积（A错），不一定表现为玻璃样变，也可表现为其他病变如动脉粥样硬化的早期，玻璃样变属于可逆性改变。原发性高血压病变过程大致为：由于细小动脉长期痉挛，加之血管内皮细胞长期受高血压刺激，使内皮细胞及基底膜受损，内皮细胞间隙扩大，通透性增强，血浆蛋白渗入血管壁中，造成可逆性损伤。同时平滑肌细胞（SMC）分泌大量细胞外基质，SMC因缺氧而变性、坏死，血管壁平滑肌萎缩（D错），管壁逐渐纤维化（E错），细动脉壁增厚，导致管腔狭窄（B错），这些均为不可逆损伤。